风寒湿痹日久，肝肾两虚，气血不足，宜选
A. 归脾汤
B. 独活寄生汤
C. 藿香正气散
D. 茵陈蒿汤
E. 八正散

正确答案：B。独活寄生汤

解析：痹证日久不愈，肝肾两虚，故见关节肿痛时轻时重，屈伸不利，肌肉瘦削；肾阴不足，腰膝失养，故见腰膝酸软；肾阳虚衰，失于温煦故见畏寒肢冷；肾阴阳不足，故见阳痿遗精；肾阴亏虚，虚火内生，故见骨蒸劳热，心烦口干，盗汗；肾阴不足，脑、耳窍失养，故见头晕耳鸣；肝肾两虚，故见舌质红或淡红，舌苔薄白或少津，脉沉细弱或细数。治法：培补肝肾，舒筋止痛。方药：独活寄生汤加减（B对）。归脾汤养血安神，补心益脾，调经，治疗心脾血虚者（A错）。藿香正气散解表和中、理气化湿功效。虽多用于外感风寒、内伤湿滞及四时感冒，但对夏季暑湿感冒效果尤为显著（C错）。茵陈蒿汤清热，利湿，退黄之功效。主治湿热黄疸（D错）。八正散清热泻火，利水通淋之功效。主治湿热淋证（E错）。